游离皮片移植后收缩性最小的是
A. 表层皮片
B. 带脂肪的全厚皮片
C. 薄中厚皮片
D. 厚中厚皮片
E. 全厚皮片

正确答案：B。带脂肪的全厚皮片

解析：本题考查游离皮片移植。游离皮片移植后收缩性最小的是带脂肪的全厚皮片（B对）。为了保存真皮下血管网，被切取的全厚皮片必须带一薄层脂肪组织，故也称带脂肪的全厚皮片，收缩性最小。表层皮片（A错）组织学上仅包括表皮层及少许真皮乳突层，皮肤极薄，其厚度约0.20～0.25mm左右，因皮片所含弹力纤维甚少，成活后挛缩严重，有时甚至可比原来面积缩小40%。中厚皮片包括表皮和一部分真皮层，按厚度不同可分为薄中厚皮片和厚中厚皮片，薄中厚皮片（C错）厚度0.35～0.5mm，收缩仍较大，厚中厚皮片（D错）厚度0.62～0.80mm，移植后收缩性较表层皮片小。全厚皮片（E错）包括表层及真皮的全层，比中厚皮片收缩性小。